左心衰引起呼吸困难的病理生理基础是
A. 左心室收缩功能减弱
B. 肺顺应性增强
C. 肺泡敏感性增加
D. 肺静脉回流增多
E. 肺动脉高压

正确答案：A。左心室收缩功能减弱

解析：左心衰时，左心室收缩功能减弱（A对），心输出量减少，引起神经-体液调节过度激活，回心血量增加，使左心室充盈压显著升高，肺循环回流受阻，久之导致肺循环淤血，表现为呼吸困难。